代谢蔗糖能力最强的细菌是
A. 轻链球菌
B. 唾液链球菌
C. 乳杆菌
D. 变形链球菌
E. 放线菌

正确答案：D。变形链球菌

解析：变形链球菌致龋过程中所涉及的最重要的物质是蔗糖。蔗糖不仅是变形链球菌的主要能量来源，其代谢蔗糖的生化活动在致龋过程中也发挥着重要作用。掌握“龋病概述”知识点。